婴儿无眼、小头等先天畸形的发生，可能是由于孕妇过多摄入
A. 钙
B. 维生素A
C. 铁
D. 维生素E
E. 蛋白质

正确答案：B。维生素A

解析：本题考查婴儿无眼、小头等先天畸形的发生原因。婴儿无眼、小头等先天畸形的发生，可能是由于孕妇过多摄入维生素A（B对ACDE错）。